主要用于表面麻醉的药物是
A. 丁卡因
B. 普鲁卡因
C. 苯妥英钠
D. 利多卡因
E. 奎尼丁

正确答案：A。丁卡因